癌基因表达的酪氨酸蛋白激酶主要是催化
A. 受其作用的酶蛋白酪氨酸残基磷酸化
B. 蛋白质丝氨酸磷酸化
C. 蛋白质苏氨酸磷酸化
D. 组蛋白磷酸化
E. 任一氨基酸磷酸化

正确答案：A。受其作用的酶蛋白酪氨酸残基磷酸化